管理舌前2/3的味觉
A. 迷走神经
B. 面神经
C. 舌咽神经
D. 三叉神经
E. 舌神经

正确答案：B。面神经

解析：迷走神经（A错）主要分布到颈部、胸腔脏器和腹腔大部分脏器。面神经（B对）发出特殊内脏感觉纤维主要支配舌前2/3的感觉。舌咽神经（C错）主要支配舌后1/3的感觉。三叉神经（D错）主要传导咀嚼肌和眼外肌的本体感觉以及面部皮肤、眼及眶内、口腔、鼻腔、鼻旁窦的黏膜、牙齿、脑膜等，传导痛、温、触等浅感觉。舌神经（E错）主要分布于舌前2/3的黏膜。